羟基脲的抗肿瘤作用机制是
A. 抑制二氢叶酸还原酶
B. 阻止嘧啶核苷酸生成
C. 阻止嘌呤核苷酸生成
D. 抑制核苷酸还原酶
E. 抑制DNA多聚酶

正确答案：D。抑制核苷酸还原酶